在工业生产中，接触煤焦油、沥青、蒽、木馏油、页岩油、石蜡能引起
A. 肺癌
B. 肝癌
C. 膀胱癌
D. 皮肤癌
E. 白血病

正确答案：D。皮肤癌

解析：本题考查引发皮肤癌的物质。职业性皮肤癌（D对ABCE错）是人类最早发现的职业性肿瘤，经常发生在致癌物的暴露部位和接触局部。能引起皮肤癌的主要化学物质有煤焦油、沥青、蒽、木熘油、页岩油、杂酚油、石蜡、氯丁二烯、砷化物等。煤焦油类物质所致接触工人的皮肤癌最多见。